心脏病患者拔牙应视为禁忌证的是
A. 一年前发生的前壁心肌梗死
B. 血压170/100mmHg
C. 未控制的心律不齐
D. 心功能Ⅱ级
E. 心功能正常的心脏病

正确答案：C。未控制的心律不齐

解析：本题考查心脏病患者拔牙的禁忌证。三度或二度Ⅱ型房室传导阻滞、双束支阻滞、阿斯综合征史者可显著增加手术时的危险性，未控制的心律不齐（C对）视为拔牙的禁忌证，此类患者拔牙必须在控制之后方可进行。心肌梗死虽然在拔牙禁忌范畴，但一年以前的前壁心肌梗死（A错）已相对稳定，可以考虑施行拔牙术。血压170/100mmHg（B错）属高血压，但还不是拔牙的禁忌证，如果血压高于180/100mmHg，则应先控制后再进行拔牙。一般而言，心脏病患者如果心功能正常（E错），或心功能为Ⅰ级或Ⅱ级（D错），也可以拔牙。